有“孤脏”之称的是
A. 肝
B. 脾
C. 肺
D. 三焦
E. 肾

正确答案：B。脾

解析：该题考查各脏腑的别称，理解记忆即可。脾为孤脏（B对）。肝为刚脏（A错）。肺有“华盖”之称（C错）。三焦为孤府（D错）。肾为水脏（E错）。